某儿童，多动，注意力不集中，多门功课成绩低下，无原发性情绪障碍。请问该儿童最有可能患有以下哪种心理-行为问题
A. 注意缺陷多动障碍
B. 学习障碍
C. 拒绝上学
D. 强迫行为
E. 心境障碍

正确答案：B。学习障碍